下列关于疯牛病的相关叙述中，不正确的是
A. 是1986年首先在英国报道的一种传染性脑病
B. 该病潜伏期很短，传播迅速，曾在欧洲很多国家都有蔓延
C. 该病由朊病毒引起
D. 发病初期，病牛体重减轻，产奶下降
E. 病原体来源于牛或羊内脏肉骨粉制作的饲料

正确答案：B。该病潜伏期很短，传播迅速，曾在欧洲很多国家都有蔓延

解析：朊病毒在人和动物中引起传染性海绵状脑病，为一种潜伏期长，中枢神经系统致死性慢性退化性疾病，动物疾病如羊瘙痒病及牛海绵状脑病（BSE，即疯牛病）等。掌握“朊粒”知识点。